成熟红细胞产生的NADPH⁺H⁺的主要功能是
A. 参与脂肪合成
B. 提供能量
C. 促进胆固醇的合成
D. 使GSSG还原为GSH
E. 参与合成氨基酸

正确答案：D。使GSSG还原为GSH